脑血栓形成的最常见病因是
A. 高血压
B. 脑动脉粥样硬化
C. 各种脑动脉炎
D. 血压偏低
E. 红细胞增多症

正确答案：B。脑动脉粥样硬化

解析：脑动脉粥样硬化的病理变化，从动脉内中膜增厚，形成粥样硬化斑块。粥样硬化斑块分为易损斑块和稳定斑块两种类型。易损斑块又称不稳定斑块，或“犯罪斑块”。其特点为斑块表面溃疡、破裂、血栓形成，斑块内出血，薄纤维帽，大脂质核，及严重血管狭窄等。目前认为易损斑块破裂是动脉粥样硬化导致血栓栓塞事件的重要原因（B对）。各种脑动脉炎（C错）、红细胞增多症（E错）、高血压病（A错）、血压偏低（D错）可引起脑血栓形成，但不为最常见原因。